严重肝功能不全的病人不宜用
A. 氢化可的松
B. 甲泼尼龙
C. 泼尼松龙
D. 泼尼松
E. 地塞米松

正确答案：D。泼尼松